有关东莨菪碱的叙述中错误的是
A. 是毒蕈碱受体的竞争性拮抗剂
B. 增加唾液分泌
C. 能够透过血脑屏障
D. 可引起嗜睡和镇静
E. 可用于抗晕动病

正确答案：B。增加唾液分泌

解析：本题考查东莨菪碱。有关东莨菪碱的叙述错误的是增加唾液分泌（B错，为本题的正确答案）。东莨菪碱是毒蕈碱受体的竞争性拮抗剂（A对）；能够透过血脑屏障（C对），可迅速、完全地进入中枢神经系统，故起中枢作用强于其他药物；东莨菪碱在治疗剂量时即可引起中枢神经系统抑制，可引起嗜睡和镇静等（D对）；可用于抗晕动病（E对），其机制可能与抑制前庭神经内耳功能或大脑皮层功能有关，可与苯海拉明合用以增加疗效；可抑制腺体分泌，故唾液分泌减少。